上皮下纤维结缔组织增生成束，束间可见淋巴细胞及浆细胞浸润，毛细血管增生不明显，属于以上哪种疾病的病理表现
A. 慢性龈炎-炎症水肿型
B. 剥脱性龈病损-疱型
C. 慢性龈炎-纤维增生型
D. 活动期牙周炎病损
E. 剥脱性龈病损-苔藓型

正确答案：C。慢性龈炎-纤维增生型

解析：本题考查牙龈疾病。上皮下纤维结缔组织增生成束，束间可见淋巴细胞及浆细胞浸润，毛细血管增生不明显，属于慢性龈炎-纤维增生型（C对）的病理表现。慢性龈炎-纤维增生型：上皮下纤维结缔组织增生成束，束间可见淋巴细胞及浆细胞浸润，毛细血管增生不明显，其炎症成分比水肿型为少。